某女，38岁，有头痛病史，前日不慎受风，头痛递作，伴鼻塞、恶风。证属外感风邪，宜选用的成药是
A. 芎菊上清丸
B. 川芎茶调散
C. 脑立清丸
D. 牛黄至宝丸
E. 正天丸

正确答案：B。川芎茶调散

解析：本题考查的是川芎茶调散的主治。有头痛病史，前日不慎受风，头痛递作，伴鼻塞、恶风。证属外感风邪，宜选用的成药是川芎茶调散（B对）。川芎茶调散：【主治】外感风邪所致的头痛，或有恶寒、发热、鼻塞。芎菊上清丸（A错）：【主治】外感风邪引起的恶风身热、偏正头痛、鼻流清涕、牙疼喉痛。脑立清丸（C错）：【主治】肝阳上亢所致的头晕目眩、耳鸣口苦、心烦难寐；高血压见上述证候者。牛黄至宝丸（D错）：【主治】胃肠积热所致的头痛眩晕、目赤耳鸣、口燥咽干、大便燥结。正天丸（E错）：【主治】外感风邪、瘀血阻络、血虚失养、肝阳上亢引起的偏头痛、紧张性头痛、神经性头痛、颈椎病型头痛、经前头痛。